属于主动靶向制剂的是
A. 磁性靶向制剂
B. 栓塞靶向制剂
C. 抗原（或抗体）修饰的靶向制剂
D. pH敏感靶向制剂
E. 热敏感靶向制剂

正确答案：C。抗原（或抗体）修饰的靶向制剂